男孩，3岁。左侧阴囊包块平卧后包块消失，质软，无触痛，透光试验阳性，最可能的诊断为
A. 精索鞘膜积液
B. 交通性鞘膜积液
C. 睾丸肿瘤
D. 股沟斜疝
E. 睾丸鞘膜积液

正确答案：B。交通性鞘膜积液

解析：男性患儿，左侧阴囊包块、质软、透光试验阳性（提示鞘膜积液），平卧后可消失（提示为交通性鞘膜积液），结合患儿的病史和体查，应诊断为右侧交通性鞘膜积液（B对）。精索鞘膜积液（A错）的囊肿常位于腹股沟或睾丸上方，平卧位时肿块不消失。睾丸肿瘤（C错）为实质性肿块，质地坚硬，透光试验呈阴性。腹股沟斜疝（P308）（D错）的肿大阴囊，平卧位阴囊内容物可回纳而消失，但透光试验亦呈阴性。睾丸鞘膜积液（E错）的临床表现与交通性鞘膜积液相似，但阴囊肿块在平卧位时不会消失。